毒物排泄主要途径是
A. 肠道
B. 唾液
C. 汗腺
D. 肾脏

正确答案：D。肾脏

解析：本题考查毒物排泄的主要途径。肾脏是机体最重要、也是最有效率的排泄器官。毒物排泄的主要途径是肾脏（D对ABC错）。